用于治疗精神分裂症的药物是
A. 氯丙嗪
B. 丙咪嗪
C. 司来吉兰
D. 哌替啶
E. 硫酸锂

正确答案：A。氯丙嗪

解析：本题考查吩噻嗪类药物氯丙嗪。用于治疗精神分裂症的药物是氯丙嗪（A对）。氯丙嗪主要用于治疗精神分裂症和躁狂症，亦可治疗神经官能症的焦虑和紧张状态，大剂量时，还可用于镇吐、低温麻醉和人工冬眠等。丙米嗪（B错）适用于治疗内源性抑郁症，反应性抑郁症及更年期抑郁症，也可用于小儿遗尿症。司来吉兰（C错）为治疗帕金森病的辅助药物。哌替啶（D错）又称杜冷丁，是一种临床常用的合成镇痛药，长期使用会产生依赖性，被列为严格管制的麻醉药品。硫酸锂（E错）主要用于躁狂症的治疗。